有关淋巴器官的描述，错误的是
A. 是身体重要防御装置
B. 可滤过淋巴
C. 能产生抗体
D. 有造血功能
E. 能产生红细胞

正确答案：E。能产生红细胞

解析：淋巴器官是身体重要的防御装置（A对），可以产生淋巴细胞：T淋巴细胞和B淋巴细胞等，而B淋巴细胞又可产生浆细胞进而产生抗体（C对）。当淋巴液流经淋巴结时,淋巴窦内的巨噬细胞可将淋巴内的细菌、病毒等异物及时吞噬，滤过淋巴（B对）。脾属于淋巴器官，有储血、造血等功能（D对）。淋巴器官不产生红细胞，红细胞由骨髓产生（E错，为本题正确答案）。